诊断抑郁症的首要症状是
A. 精力明显减退疲乏
B. 思维困难、联想缓慢
C. 情绪低落，兴趣下降
D. 自卑、自责、自杀观念
E. 失眠、早醒、体重减轻

正确答案：C。情绪低落，兴趣下降

解析：抑郁发作以显著而持久的情感低落（C对）为主要表现，伴有兴趣缺乏、快感缺失、思维迟缓、意志活动减少、精神运动性迟滞或激越、自责自罪、自杀观念和行为、早醒、食欲减退、体重下降、性欲减退、抑郁心境晨重晚轻的节律改变等。精力明显减退疲乏、思维困难联想缓慢（思维迟缓）、自卑自责自杀观念、失眠、早醒、体重减轻为抑郁症的临床表现，但均不是首要表现（ABDE错）。